糖尿病肾病患者宜选用
A. 胰岛素
B. 二甲双胍
C. 格列喹酮
D. 瑞格列奈
E. 阿卡波糖

正确答案：C。格列喹酮

解析：本题考查降糖药。糖尿病合并肾病者可首选格列喹酮（C对）。胰岛素（A错）注射给药可用于治疗1型糖尿病、2型糖尿病和妊娠糖尿病。二甲双胍（B错）可作为2型肥胖型糖尿病的首选。瑞格列奈（D错）在2型非肥胖型糖尿病患有良好的胰岛β细胞储备功能、无高胰岛素血症时应用。阿卡波糖（E错）可作为单纯餐后血糖高，而空腹和餐前血糖不高的首选。